某县疾病预防控制中心接到报告，某高校食堂发生腹泻暴发，经调查共有121人发病，结合临床表现和实验室检查确诊为细菌性痢疾。该暴发最有可能的传播途径是
A. 经污染食物传播
B. 经间接接触传播
C. 经蟑螂传播
D. 经直接接触传播
E. 经食堂炊事员传播

正确答案：A。经污染食物传播

解析：本题考查感染性腹泻的传播途径。经污染的食物传播是感染性腹泻的重要传播途径。细菌性痢疾是由痢疾杆菌引起的肠道传染病，高校食堂发生腹泻暴发最有可能的传播途径是经污染的食物传播（A对BCDE错）。